下列哪项不是慢性盆腔炎的临床表现
A. 少腹一侧或双侧隐痛，反复发作
B. 突然少腹剧痛，伴有停经史
C. 带下增多，色黄质稠
D. 经量增多，经期延长或婚久不孕
E. 妇科检查附件增厚，有压痛

正确答案：B。突然少腹剧痛，伴有停经史

解析：突然少腹剧痛，伴有停经史（B错，为本题正确答案）多先考虑是否为先兆流产。慢性盆腔疼痛是少腹一侧或双侧隐痛小腹或坠胀疼痛，腰骶部酸痛，反复发作（A对），带下增多，色黄质稠白带黄稠、量多或有异味（C对），月经不调，经量增多或经期延长，可有婚久不孕表现（D对），妇科检查：可有附件增厚，子宫压痛（+）（E对）。